按我国有关药品广告管理规定，可进行广告宣传的药品有
A. 非麻醉性戒毒药品
B. 医院制剂
C. 经批准试生产的药品
D. 境外生产的药品
E. 二类精神药品

正确答案：D。境外生产的药品

解析：本题考查可以发布广告的药品。按我国有关药品广告管理规定，可进行广告宣传的药品有境外生产的药品（D对）。按照规定，不得做广告的产品包括：①麻醉药品、精神药品（E错）、医疗用毒性药品、放射性药品、药品类易制毒化学品，以及戒毒治疗的药品（A错）、医疗器械；②军队特需药品、军队医疗机构配制的制剂；③医疗机构配制的制剂（B错）；④依法停止或者禁止生产、销售或者使用的药品、医疗器械、保健食品和特殊医学用途配方食品；⑤法律、行政法规禁止发布广告的情形；⑥批准试生产的药品（C错）。